牙龈纤维瘤病的特征是
A. 牙龈质地松软
B. 从不发生在乳牙
C. 牙龈增生盖过牙冠2/3
D. 不累及附着龈
E. 牙龈颜色正常

正确答案：C。牙龈增生盖过牙冠2/3

解析：本题考查牙龈纤维瘤病的特征。牙龈纤维瘤病的特征是牙龈增生盖过牙冠2/3（C对）。牙龈纤维瘤病牙龈广泛地增生，可盖过牙冠2/3。白血病的牙龈病损常有牙龈质地松软（A错）的特征。牙龈纤维瘤病可在幼儿时就发病（B错）。牙龈纤维瘤病可累及全口的牙龈缘、龈乳头和附着龈，甚至达膜龈联合处（D错）。牙龈瘤牙龈颜色与正常牙龈无多大差别，故牙龈颜色正常（E错）不是牙龈纤维瘤病的特征。